影响矽肺发病的重要因素有很多，以下哪项除外
A. 粉尘中游离二氧化硅类型
B. 二氧化硅含量
C. 粉尘浓度
D. 劳动者心情
E. 接尘时间

正确答案：D。劳动者心情

解析：本题考查影响矽肺发病的主要因素。矽肺的发病受多种因素的影响，粉尘中游离SiO₂含量（B对）、SiO₂ 类型（A对）、粉尘浓度（C对）、分散度、接尘工龄（E对）、防护措施、接触者个体因素等都是矽肺发病的重要影响因素，在诸多影响因素中，蓄积在肺中的粉尘量越多，影响越大，而劳动者的心情（D错，为本题正确答案），与矽肺发病无关。